卫生部颁布的“食品卫生检验方法”中不包括
A. 理化检验
B. 微生物检验
C. 放射性物质检验
D. 危害分析关键控制点
E. 食品安全性毒理学评价

正确答案：D。危害分析关键控制点